接种单位应当具备下列条件，但除外
A. 具有医疗机构执业许可证件
B. 具有经过县级人民政府卫生主管部门组织的预防接种专业培训并考核合格的执业医师、执业助理医师、护士或者乡村医生
C. 具有符合疫苗储存、运输管理规范的冷藏设施和设备
D. 具有符合疫苗储存、运输管理规范的冷藏保管制度
E. 应当设立预防接种门诊

正确答案：E。应当设立预防接种门诊